食用新鲜蚕豆发生溶血性黄痘，患者缺陷的酶是
A. 3-磷酸甘油醛脱氢酶
B. 异柠檬酸脱氢酶
C. 琥珀酸脱氢酶
D. 葡萄糖-6-磷酸脱氢酶
E. 葡萄糖酸-6-磷酸脱氢酶

正确答案：D。葡萄糖-6-磷酸脱氢酶